成人颏孔多位于
A. 下颌第一前磨牙下方
B. 下颌第一磨牙下方
C. 下颌第二磨牙下方
D. 下颌第一、第二磨牙之间的下方
E. 下颌第二前磨牙的下方

正确答案：E。下颌第二前磨牙的下方

解析：颏孔位于下颌体外侧面，多位于下颌第二前磨牙或下颌第一、第二前磨牙之间的下方，下颌体上、下缘中点微上方，距正中线约2～3cm。掌握“面部表面解剖”知识点。